患者，女，41岁，BMI25，最新诊断为2型糖尿病，空腹血糖8.4mmol/L，餐后2小时血糖16mmol/L，血肌酐70㎛ol/L。为满足患者减轻体重的要求，不宜选用的降糖药物是
A. 阿卡波糖
B. 西格列汀
C. 利拉鲁肽
D. 格列齐特
E. 二甲双胍

正确答案：D。格列齐特

解析：本题考查格列齐特。为满足患者减轻体重的要求，不宜选用的降糖药物是格列齐特（D错，为本题正确答案）。格列齐特用于单用饮食疗法、运动疗法和减轻体重不足以控制血糖水平的成人非胰岛素依赖型糖尿病。